20世纪70年代起，美国健康服务的重点逐步向哪里转移
A. 疾病
B. 健康
C. 个人
D. 患者
E. 社区

正确答案：E。社区